中毒型菌痢最严重的临床症状是
A. 高热
B. 呼吸衰竭
C. 循环衰竭
D. 惊厥
E. 昏迷

正确答案：C。循环衰竭

解析：中毒型菌痢休克型即周围循环衰竭（C对）型，表现为感染中毒性休克，由于微循环障碍，出现面色苍白，皮肤花斑，口唇发绀，四肢厥冷，血压下降甚至测不出，脉搏细数，少尿或无尿，亦可有程度不等的意识障碍。此型较为常见。重型患者不易逆转，可致多脏器功能损伤与衰竭，危及生命。